环氧溴苯大剂量给予动物时，出现DNA、RNA及蛋白质损伤的机制是
A. 环氧溴苯在酶的作用下，两个碳原子之间形成桥式结构
B. 大量环氧溴苯可把GSH全部耗尽
C. 体内多余的环氧溴苯与DNA共价结合
D. 也可与RNA、蛋白质共价结合
E. 以上都对

正确答案：E。以上都对